关于楔束哪一种说法错误
A. 穿整个脊髓全长
B. 终止于同侧延髓的楔束核
C. 在脊髓后索上行
D. 位于薄束的外侧
E. 无

正确答案：A。穿整个脊髓全长

解析：楔束起自同侧第 4 胸节及以上的脊神经节细胞,而非穿整个脊髓全长（A错，为本题正确答案），在脊髓后索上行（C对），止于延髓的薄束核和楔束核（B对），楔束位于后索的外侧（D对）。